患者，男，70岁。患冠心病多年，胸痛绵绵，心悸少寐，气短乏力，五心烦热，汗多口干，眩晕耳鸣，两颧微红，舌红少苔，脉细数无力。治疗应首选
A. 生脉散
B. 知柏地黄丸
C. 保元汤
D. 血府逐瘀汤
E. 瓜蒌薤白半夏汤

正确答案：B。知柏地黄丸

解析：病延日久，长期气血运行失畅，瘀滞痹阻，故见胸痛绵绵；不能充养五脏，而致心肾阴虚，心阴虚可见心悸少寐，气短乏力，五心烦热，汗多口干；肾阴虚则眩晕耳鸣，两颧微红；水不涵木，肝阳偏亢故见头晕；舌红少苔，脉细数无力，均为心肾阴虚症候，治疗应补益肝肾，滋阴清热，方选知柏地黄丸加减（B对）。生脉散（A错）可以益气养阴，活血通络，用于治疗气阴两虚证。保元汤（C错）可以益气壮阳，温经止痛，用于治疗心肾阳虚证。血府逐瘀汤（D错）可以活血化瘀，通脉止痛，用于治疗心血瘀阻证。瓜蒌薤白半夏汤（E错）可以通阳泄浊，豁痰开痹，用于治疗痰浊内阻证。